不是影响环境污染物在靶部位蓄积量的因素的是
A. 暴露频度
B. 暴露期
C. 化合物的生物半减期
D. 摄入量
E. 化合物的生物放大作用

正确答案：E。化合物的生物放大作用

解析：本题考查影响环境污染物在靶部位蓄积量的因素。。影响环境污染物在靶部位蓄积量的因素有暴露频度（A对）、暴露期（B对）、化合物的生物半减期（C对）和摄入量（D对）。化合物的生物放大作用（E错，为本题正确答案）是有害物质随着食物链使高位营养级生物体内浓度比低位营养级生物体内浓度逐渐加大的现象，不是影响环境污染物在靶部位蓄积量的因素。